病例对照研究中常用的对照来源中，下列哪组最接近全人口的无偏样本
A. 病例的配偶、同胞、亲戚、同班同学等
B. 同一或多个医疗机构中诊断的其他病例
C. 病例的邻居或所在居委、住宅区内的健康人或非该病患者
D. 社会人口中的非病例或健康人群的抽样
E. 社会团体人群中的非该病例患者或健康人的抽样

正确答案：D。社会人口中的非病例或健康人群的抽样

解析：本题考查病例对照研究中的对照来源。病例对照研究中的对照来源主要有：①同一个或多个医疗机构中诊断的其他疾病的病人；②社区人群或团体人群中非该病病例或健康人；③社会人口中的非病例或健康人群；④病例的邻居或同一住宅区内的健康人或非该病病例；⑤病例的配偶、同胞、亲戚、同学或同事等。其中社会人口中的非病例或健康人群的抽样（D对ABCE错）最接近全人口的无偏样本。